急性弥漫性腹膜炎手术治疗的步骤不包括
A. 寻找引起腹膜炎的原发灶
B. 术后一般放置腹腔引流
C. 根据病变脏器的部位确定手术切口
D. 用生理盐水冲洗腹腔至清洁
E. 关腹前均在腹腔内用抗生素控制感染

正确答案：E。关腹前均在腹腔内用抗生素控制感染

解析：急性弥漫性腹膜炎多由腹腔空腔脏器穿孔或内脏破裂所致，容易继发感染，因此绝大多数需及时手术治疗。手术关腹前一般不在腹腔内应用抗生素，以免造成严重的粘连（E错，为本题正确答案）。手术多选用全身麻醉或硬膜外麻醉，根据病变脏器的部位确定手术切口（C对），开腹探查要小心轻柔，寻找引起腹膜炎的原发灶（A对），并根据脏器损伤情况决定处理方法；开腹后可用生理盐水彻底冲洗腹腔至清洁（D对）。为减轻腹腔感染，防止腹腔内的残留液和继续产生的渗出液形成腹腔脓肿，术后一般要放置引流管充分引流（B对）。